取后头和项背部的腧穴，最适宜选用
A. 仰卧位
B. 侧卧位
C. 仰靠坐位
D. 俯伏坐位
E. 侧伏坐位

正确答案：D。俯伏坐位

解析：取后头和项背部的腧穴，最适宜选用俯伏坐位（D对），既有利于腧穴的正确定位，又便于针灸操作和较长时间留针而患者不致疲劳。